慢性根尖周炎的诊断主要依靠
A. 牙髓电活力检查
B. 冷热刺激检查
C. 咬诊和叩诊
D. 探诊和扪诊
E. X线检查

正确答案：E。X线检查

解析：本题考查慢性根尖周炎的诊断要点。慢性根尖周炎的诊断主要依靠X线检查（E对）。慢性根尖周炎可分为慢性根尖周肉芽肿、慢性根尖周脓肿。根尖周囊肿，三者需依据X线才能鉴别。牙髓电活力测验无反应，不是诊断的主要依据，牙髓坏死的牙髓电活力测验也无反应（A错）。患牙对叩诊的反应无明显异常或仅有不适感，不能作为诊断的依据，慢性根尖周炎一般无明显的自觉症状，有的患牙可有咀嚼不适（C错）。